干姜的功效是
A. 温中散寒，回阳救逆
B. 温中降逆，温肾助阳
C. 温肾助阳，散寒止痛
D. 补火助阳，温中降逆
E. 温肺化饮，散寒止痛

正确答案：A。温中散寒，回阳救逆

解析：干姜辛热燥烈，主入脾胃而长于温中散寒、健运脾阳，“治感寒腹痛”，为温暖中焦之主药。入心、脾、肾经，有温阳守中，回阳通脉的功效，常配附子治亡阳欲脱。入肺经，善于温肺散寒化饮。治寒饮喘咳（A对）。功效为温中降逆，温肾助阳（B错）的中药是丁香。功效为温肾助阳，散寒止痛（C错）的中药是附子、肉桂。功效为温肺化饮，散寒止痛（E错）的中药是细辛。